影响外周阻力的最主要的因素是
A. 血液粘滞性
B. 红细胞数目
C. 血管长度
D. 小动脉口径
E. 小静脉口径

正确答案：D。小动脉口径